下列不是慢性肾小球肾炎基本临床表现的是
A. 蛋白尿
B. 不同程度的肾功能减退
C. 高血压
D. 水肿
E. 血尿

正确答案：B。不同程度的肾功能减退

解析：慢性肾小球肾炎的基本临床表现为蛋白尿（A对）、血尿（E对）、高血压（C对）、水肿（D对），可伴有不同程度的肾功能减退，但肾功能减退不是慢性肾小球肾炎的基本临床表现（B错，为本题正确答案）。